头胸部与前腹部成扁平长椭圆形，后腹部呈尾状，末节有锐钩状毒针的药材是
A. 蜈蚣
B. 海马
C. 全蝎
D. 土鳖虫
E. 斑蝥

正确答案：C。全蝎

解析：本题考查的是全蝎的性状鉴别。头胸部与前腹部成扁平长椭圆形，后腹部呈尾状，末节有锐钩状毒针的药材是全蝎（C对）。全蝎：【性状鉴别】药材头胸部与前腹部呈扁平长椭圆形，后腹部呈尾状，皱缩弯曲。头胸部呈绿褐色，前面有1对短小的螯肢及1对较长大的钳状脚须，形似蟹螯，背面覆有梯形背甲，腹面有足4对；前腹部由7节组成。背面绿褐色，后腹部棕黄色，6节，节上均有纵沟，末节有锐钩状毒刺，毒刺下方无距。气微腥，味咸。蜈蚣（A错）：【性状鉴别】药材呈扁平长条形。由头部和躯干部组成，全体共22个环节。头部暗红色或红褐色，略有光泽，有头板覆盖，头板近圆形，前端稍突出，两侧贴有颚肢1对，前端两侧有触角1对。躯干部第1背板与头板同色，其余20个背板为棕绿色或墨绿色，具光泽，自第4背板至第20背板常有2条纵沟线；腹部淡黄色或棕黄色，皱缩；自第2节起，每体节两侧有步足1对，步足黄色或红褐色，偶有黄白色，呈弯钩形，最末一对步足尾状，故又称尾足，易脱落。质脆，断面有裂隙。气微腥，并有特殊刺鼻的臭气，味辛、微咸。海马（B错）：【性状鉴别】药材线纹海马呈扁长形而弯曲。表面黄白色。头略似马头，有冠状突起，具管状长吻，口小，无牙，两眼深陷。躯干部七棱形；尾部四棱形，渐细卷曲，体上有瓦楞形的节纹并具短棘。体轻，骨质，坚硬。气微腥，味微咸。土鳖虫（D错）：【性状鉴别】药材呈扁平卵形，前端较窄，后端较宽，背部紫褐色，具光泽，无翅。前胸背板较发达，盖住头部；腹背板9节，呈覆瓦状排列。腹面红棕色，头部较小，有丝状触角1对，常脱落，胸部有足3对，具细毛和刺。腹部有横环节。质松脆，易碎。气腥臭，味微咸。斑蝥（E错）：【性状鉴别】药材南方大斑蝥呈长圆形。头及口器向下垂，有较大的复眼及触角各1对，触角多已脱落。背部具革质鞘翅1对，黑色，有3条黄色或棕黄色的横纹；鞘翅下面有棕褐色薄膜状透明的内翅2片。胸腹部乌黑色，胸部有足3对。有特殊的臭气。